原料药中常需检查的一般杂质是
A. 熔点
B. 有关物质
C. 含量均匀度
D. 干燥失重
E. 溶解度

正确答案：D。干燥失重

解析：本题考查一般杂质检查法。一般杂质是指在自然界中分布广泛、在多种药品的生产过程中容易引入的杂质，如氯化物、重金属、砷盐、干燥失重（D对）或水分、炽灼残渣、残留溶剂等。